患者，女，33岁。平素易生闷气，经行期乳房胀痛明显，此次妊娠后觉小腹胀痛不适，情志不畅，嗳气叹息，夜寐、食欲不佳，舌红，苔薄黄，脉弦滑。可诊断为
A. 妊娠恶阻
B. 经行情志异常
C. 胎动不安
D. 妊娠腹痛
E. 经行乳房胀痛

正确答案：D。妊娠腹痛

解析：该患者以妊娠后小腹胀痛不适为主要症状，故辨病为妊娠腹痛（D对）。妊娠恶阻为妊娠早期，出现严重的恶心呕吐，头晕厌食，甚则食入即吐（A错）。经行情志异常为每值行经前后，或正直经期，出现烦躁易怒，悲伤啼哭，或情志抑郁，喃喃自语，或彻夜不眠，甚或狂躁不安，经后又复如常人（B错）。妊娠期间出现腰酸、腹痛、小腹下坠，或伴有阴道少量流血者，为胎动不安（C错）。经行乳房胀痛为每于行经前后，或正值经期，出现乳房作胀，或乳头胀痒疼痛，甚至不能触衣（E错）。